肝脓肿的特点正确的是
A. 细菌性肝脓肿常为单发较大
B. 阿米巴肝脓肿起病急，伴寒战高热
C. 阿米巴肝脓肿较多为多发性
D. 阿米巴肝脓肿脓液为褐色，无臭味
E. 阿米巴肝脓肿病人粪便中可找到阿米巴原虫

正确答案：D。阿米巴肝脓肿脓液为褐色，无臭味

解析：阿米巴肝脓肿脓液为褐色，无臭味（D对）。细菌性肝脓肿以小型、多个为多见（A错）。阿米巴肝脓肿起病较慢，病程长（B错）。阿米巴肝脓肿常为大型单个，多见于右叶（C错）。阿米巴肝脓肿病人粪便中可找到滋养体和包囊，不能找到阿米巴原虫（E错）。